男，20岁，大学生。不食不语伴行为异常6个月。曾在当地医院就诊，此次入院检查：神志清，仰卧，头颈悬空不动，无自发言语，面无表情，拒绝服从医生的简单指令，眼球活动自如，有时突然拍门或抢病友的东西。体格检查未见异常。能够最快缓解其症状的治疗措施是
A. 改良电抽搐治疗
B. 口服利培酮
C. 肌注氟哌啶醇
D. 肌注地西泮
E. 静脉滴注氯丙嗪

正确答案：A。改良电抽搐治疗

解析：该患者青年起病，6个月不食不语伴行为异常（紧张性木僵），拒绝服从医生的简单指令（违拗），有时突然拍门或抢病友的东西（紧张性兴奋），故诊断为紧张型精神分裂症，对于木僵、伤人、损物者，应选用电抽搐治疗缓解症状（A对）。